前界为咬肌前缘是
A. 眶下间隙
B. 颊间隙
C. 咬肌间隙
D. 颞下间隙
E. 颞间隙

正确答案：C。咬肌间隙

解析：本题考查面侧深区及颌面部各间隙的境界。前界为咬肌前缘是咬肌间隙（C对），又称咬肌下间隙，位于咬肌与下颌支之间。前界咬肌前缘，后界腮腺，上达颧弓，下至下颌下缘。